为了防止碰伤儿童，某品牌的家具推出磨平棱角的款式。这属于下面哪种干预措施
A. 主动干预
B. 教育干预
C. 技术干预
D. 强制干预
E. 紧急处置

正确答案：C。技术干预